吞咽是一个复杂过程，一般每人每天吞咽约
A. 400次
B. 800次
C. 1400次
D. 2400次
E. 3400次

正确答案：D。2400次

解析：吞咽是一个复杂过程，为吞咽中枢所控制。这个过程以自主运动开始，随后为非自主运动；其全过程平均仅几秒钟。每人每天吞咽约2400次。掌握“吞咽、呼吸及言语”知识点。